临床创口分类中包括
A. 无菌创口、污染创口、感染创口
B. 污染创口、感染创口、可疑创口
C. 感染创口、无菌创口、化脓创口
D. 化脓创口、无菌创口、污染创口
E. 无菌创口、可疑创口、污染创口

正确答案：A。无菌创口、污染创口、感染创口

解析：本题考查临床创口分类。临床创口分类中包括无菌创口、污染创口、感染创口（A对）。临床上，根据创口是否受到污染或感染而分为清洁创口（即无菌创口）、污染创口（包括清洁污染创口）和感染创口三种（BCDE错）。